在人群中最容易实现的传播途径是
A. 经水传播
B. 经接触传播
C. 经食物传播
D. 经土壤传播
E. 经空气传播

正确答案：E。经空气传播